我国发生的严重急性呼吸综合征（SARS）很快波及到许多省市，这种发病情况称为
A. 爆发
B. 大流行
C. 季节性升高
D. 周期性流行
E. 长期变异

正确答案：B。大流行

解析：本题考查大流行。我国发生的严重急性呼吸综合征（SARS）很快波及到许多省市，这种发病情况称为大流行（B对）。爆发（A错）为在某一局部地区或集体单位中，短期内突然出现许多同一疾病的患者，大多是同一传染源或同一传播途径，如食物中毒、流行性感冒等。季节性升高（C错）指由于气温的高低和昆虫媒介的有无，不少传染病的发病率每年在一定季节都有一定的升高。周期性流行（D错）指疾病频率按照一定的时间间隔，有规律的起伏波动，每隔若干年出现一个流行高峰的现象。长期变异（E错）指人类许多疾病在一个相当长时间内随着社会生活条件改变，医疗技术的进步，自然条件的变化而发生显著变化，使其感染类型、病原体种类及宿主均有很大的不同。